男性，30岁，1年前下岗。近5个月来觉得邻居都在议论他，常不怀好意地盯着他，有时对着窗外大骂，自语自笑，整天闭门不出，拨110电话要求保护。治疗应首先选用
A. 碳酸锂
B. 三环类抗抑郁药
C. 电休克
D. 苯二氮䓬类
E. 氯丙嗪

正确答案：E。氯丙嗪

解析：该病例患者中年男性，1年前下岗。近5个月来觉得邻居都在议论他（幻听），常不怀好意地盯着他（妄想），闭门不出（妄想、幻觉的支配下所表现的行为），故诊断为精神分裂症偏执型。氯丙嗪为第一代抗精神病药物，作为首选治疗措施（E对）。碳酸锂是最常见的心境稳定剂（抗躁狂药物），主要用于躁狂发作（A错）。三环类抗抑郁药主要用于抑郁发作（B错）。电休克（ECT，电抽搐）治疗用于精神药物治疗无效或精神药物无效不能耐受者（C错）。苯二氮䓬类药物主要用于抗焦虑（D错）。